检查发现病人尺骨近端1/3骨折伴桡骨小头脱位诊断为
A. 尺骨骨折
B. Galeazzi骨折
C. Monteggia骨折
D. Colles骨折
E. 肘关节脱位

正确答案：C。Monteggia骨折

解析：尺骨上1/3骨干骨折可合并桡骨小头脱位，称为孟氏（Moteggia）（C对）骨折。因有桡骨支撑，尺骨干单骨折极少见，多见于直接暴力。桡骨干下1/3骨折合并尺骨小头脱位，称为盖氏（Galeazzi）骨折（B错）。伸直型骨折（Colles骨折）（D错）多由于腕关节处于背伸位、手掌着地、前臂旋前时受伤导致，可出现典型畸形姿势，即侧面看呈“银叉”畸形，正面看呈“刺刀样”畸形。X线拍片可见骨折远端向桡、背侧移位，近端向掌侧移位。肘关节脱位（E错）时常有肘后三角关系改变。